介绍新药，答复咨询，编写《药讯》必须
A. 紧密结合临床
B. 内容广泛多样
C. 更新传递快速
D. 强调经济效益
E. 展望未来发展

正确答案：A。紧密结合临床